牙体缺损的定义
A. 各种牙体组织不同程度的质地损坏或异常
B. 各种牙体组织不同程度的生理解剖外形的损坏或异常
C. 各种牙体组织不同程度的质地和生理解剖外形的损坏或异常
D. 各种牙体硬组织不同程度的质地和生理解剖外形的损坏或异常
E. 牙体软组织不同程度的质地损坏或异常

正确答案：D。各种牙体硬组织不同程度的质地和生理解剖外形的损坏或异常

解析：本题考查牙体缺损。牙体缺损是指牙体硬组织不同程度的质地和生理解剖外形的损坏或异常（D对E错），造成牙体形态、咬合和邻接关系的异常，影响牙髓和牙周组织甚至全身的健康。而牙体组织包括牙体硬组织的牙釉质、牙本质、牙骨质和牙体软组织的牙髓（ABC错）。